抗癫痫作用
A. 苯巴比妥
B. 苯妥英钠
C. 两者均有效
D. 两者均无效

正确答案：C。两者均有效